槟榔驱绦虫的成人一日用量是
A. 1～3g
B. 3～6g
C. 6～15g
D. 15～30g
E. 60～120g

正确答案：E。60～120g